患者产后32天恶露不止，量多，色淡，神疲倦怠。小腹空坠，舌质淡，脉细弱
A. 血热证
B. 气虚证
C. 血瘀证
D. 湿热证
E. 肾虚证

正确答案：B。气虚证

解析：患者产后32天恶露不止，量多，色淡，神疲倦怠。小腹空坠，舌质淡，脉细弱为产后恶露不绝气虚证表现（B对）。产后恶露不尽血热证表现为恶露量较多、色深红、质黏稠、有臭味；面色潮红，口燥咽干（A错）。产后恶露不尽血热证表现为恶露量少、色紫黯有块、小腹疼痛拒按（C错）。产后恶露不行无湿热证、肾虚证（DE错）。